男性，42岁，自幼起咳嗽咳痰喘息，多为受凉后发作，静滴“青霉素”可缓解，10～20岁无发作。20岁后又有1次大发作，发作时大汗淋漓、全身发紫端坐不能平卧，肺部可闻及哮鸣音，静脉推注“氨茶碱地塞米松”可完全缓解。自后反复出现夜间轻微喘息，每周发作3次以上，不能入睡，PEF变异率为35%。查体：双肺听诊未闻及干湿啰音，心率89次/分。最可能的诊断是
A. 支气管哮喘急性发作期
B. 支气管哮喘非急性发作期
C. 先天性心脏病急性左心衰竭
D. 肺源性心脏病心功能不全
E. 喘息型慢性支气管炎急性发作

正确答案：B。支气管哮喘非急性发作期

解析：患者为中年男性，自幼出现咳嗽咳痰喘息，发作时可闻及哮鸣音（为支气管哮喘的典型表现），静注“氨茶碱地塞米松”可完全缓解，PEF变异率为35%，由此考虑该患者为支气管哮喘。该患者没有哮喘的急性发作，但是在相当长的时间内仍有不同频度和不同程度的喘息等症状，故最可能的诊断为支气管哮喘非急性发作期（B对）。支气管哮喘急性发作期（A错）指喘息、气急、胸闷或咳嗽等症状突然发生或症状加重，伴有呼气流量降低，常因接触变应原等刺激物或治疗不当所致。先天性心脏病急性左心衰竭（C错）表现为突发严重呼吸困难，发绀、大汗、烦躁，同时频繁咳嗽，咳粉红色泡沫状痰，双肺可闻及湿啰音。肺源性心脏病心功能不全（D错）最常见的病因为慢阻肺，可有不同程度的发绀，原发肺脏疾病体征，如肺气肿体征，干、湿性啰音，P₂＞A₂，三尖瓣区可出现收缩期杂音。喘息性慢性支气管炎（E错）的发病年龄较晚，家属史和过敏史不显著，先有咳嗽及咳痰，以后才发展为喘息症状，在秋冬季节或感冒时症状加重，咳嗽、咳痰及喘息迁延不愈，呼气延长，有时肺底部可听到湿性啰音或哮鸣音，应用支气管扩张药后肺功能改善不明显。